患者，男，49岁，因寒战高热咳嗽4天入院。查体：血压110/70mmHg，急性病容，呼吸急促，口唇发绀，右下肺可听到支气管呼吸音，X线胸片示：肺段大片均匀炎症浸润阴影实验室检查：血常规：白细胞总数11.9×10⁹/L，中性粒细胞百分比0.76%。下列治法错误的是
A. 一经诊断应立即开始抗生素治疗
B. 首选青霉素G
C. 病人应卧床休息，宜食用营养而易消化的食物
D. 可应用大环内酯类氟喹诺酮类头孢菌素类药物治疗
E. 首先应用退热剂，使体温尽快恢复正常

正确答案：E。首先应用退热剂，使体温尽快恢复正常

解析：在控制体温后可以依据感染病菌合理使用抗生素，卧床休息及合理膳食（ABCD对）。肺炎发热 尽量少用阿司匹林或其他解热药，以免过度出汗、脱水及干扰热型观察。（E错，为本题正确答案）。